下列关于肾功能不全患者用药原则叙述正确的有
A. 明确诊断，合理选药
B. 避免或减少使用肾毒性大的药物
C. 注意药物相互作用，特别应避免与肾毒性的药物合用
D. 肾功能不全，而肝功能异常者可选用双通道（肝肾）排泄的药物
E. 设计个体化给药方案，必要时进行TDM

正确答案：A、B、C、E。明确诊断，合理选药；避免或减少使用肾毒性大的药物；注意药物相互作用，特别应避免与肾毒性的药物合用；设计个体化给药方案，必要时进行TDM

解析：本题考查肾功能不全患者用药。肾功能不全患者用药原则：1.明确诊断，合理选药（A对）。2.避免或减少使用肾毒性大的药物（B对）。3.注意药物相互作用，特别应避免与具有肾毒性的药物合用（C对）。4.肾功能不全而肝功能正常者可选用经双通道（肝、肾）消除的药物。5.根据肾功能的情况调整用药剂量和给药间隔时间，必要时进行治疗药物监测，设计个体化给药方案（E对）。